最适于进行输卵管结扎术的时间是
A. 月经来潮前3～4天
B. 足月产后14天
C. 难产后72天
D. 人工流产术后3天
E. 月经后3～4天

正确答案：E。月经后3～4天

解析：最适宜进行输卵管结扎术手术时间是：非孕妇女在月经干净后3～4日（E对A错）；人工流产或分娩后亦在48小时内施术（BD错）；难产者（第2版实用妇产科学P1010）（C错）在抗生素预防感染3～5天后可考虑手术；哺乳期或闭经妇女应排除早孕后再行绝育术。